每次体育课都要进行10分钟左右的热身运动，这属于运动损伤预防措施中的
A. 安全防范法
B. 保护帮助法
C. 量力适应法
D. 准备活动法
E. 消除疲劳法

正确答案：D。准备活动法